女，38岁，G2P2，接触性阴道流血半年，妇科检查，外阴阴道无异常，宫颈糜烂状，下唇略突起，宫体正常大小，双附件区未触及包块，双合诊双侧宫旁无异常，TCT检查示HSIL，高危型HPV阳性，若结果示HSIL（CIN3）累积腺体，6点处为鳞状细胞癌，局部间质浸润深度8mm，分期为
A. ⅢA期
B. IA期
C. ⅡA期
D. ⅡB期
E. IB期

正确答案：E。IB期

解析：子宫颈癌ⅠB期（E对）为临床癌灶局限于子宫颈。ⅡA期（C错）为肿瘤侵犯阴道上2/3，无明显宫旁浸润。ⅡB期（D错）为有明显宫旁浸润（右侧附件侵润），但未达盆壁。ⅢA期（A错）为肿瘤累及阴道下1/3，没有扩展到骨盆壁。ⅠA期（B错）镜下浸润癌。